污染物对机体所起的毒害作用主要取决于
A. 环境中污染物的浓度
B. 机体对污染物的吸收量
C. 环境污染物在环境中的形态
D. 环境污染物的理化特性
E. 环境污染物在人体内半减期的长短

正确答案：B。机体对污染物的吸收量

解析：本题考查污染物对机体所起的毒害作用的取决因素。机体对污染物的吸收量（B对ACDE错）是决定污染物对机体的毒害作用的最重要因素，它的作用大小还取决于污染物的浓度、形态、理化特性和半减期长短等因素。